某学校教师健康体检时发现一名任课教师为乙肝“小三阳”携带者，则对该职工采取的措施正确的是
A. 调离教师岗位
B. 劝其离职
C. 告知学生或学生家长
D. 安排该教师进行HBV疫苗接种
E. 减轻该教师工作量，对他（她）进行相关防护知识教育

正确答案：E。减轻该教师工作量，对他（她）进行相关防护知识教育